十二经别的循行分布特点，按先后顺序排列的是
A. 出、入、离、合
B. 入、离、出、合
C. 离、入、出、合
D. 离、合、出、入
E. 出、离、入、合

正确答案：C。离、入、出、合

解析：十二经别是十二正经离、入、出、合（C对）的别行部分，是正经别行深入体腔的支脉。